急性胃炎的确诊依赖于
A. 急诊纤维胃镜检
B. B型超声波检
C. 腹X线平片
D. 血常规检查
E. 胃黏膜活检

正确答案：A。急诊纤维胃镜检